葶苈子的性味是
A. 辛；苦；大寒
B. 甘，寒
C. 甘、苦、涩，平
D. 辛 苦 平
E. 辛、温

正确答案：A。辛；苦；大寒

解析：本题考查葶苈子的性味，虚理解记忆。葶苈子药性为苦、辛，大寒。归肺、膀胱经（A对）。